初产妇，27岁。妊娠32周，阴道少量流血及规律腹痛2小时。肛门检查宫颈管消失，宫口开大1.5cm。为促使胎儿肺成熟，应给予
A. 5%葡萄糖液
B. 三磷酸腺苷
C. 倍他米松
D. 硝苯地平
E. 辅酶A

正确答案：C。倍他米松

解析：妊娠＜34周的胎儿，由于胎肺发育不成熟，出生后死亡率极高，1周内有可能分娩的孕妇，应首先给予糖皮质激素如倍他米松（C对）促进胎肺成熟。5%葡萄糖液（A错）用于补充机体能量；三磷酸腺苷（P60）（B错）通过合成环磷酰苷降低细胞内钙离子浓度；硝苯地平（P61）（D错）为钙离子通道阻滞剂，通过减少钙离子内流，均可抑制子宫收缩；辅酶A（E错）是一种含有泛酸的辅酶，在某些酶促反应中作为酰基的载体，以上对促进胎儿肺成熟均无作用。